宜用温水浸泡，严禁直接服用和口含的剂型是
A. 泡腾片剂
B. 舌下片
C. 激素类气雾剂
D. 缓控释制剂
E. 透皮贴剂

正确答案：A。泡腾片剂

解析：本题考查各种剂型的正确使用。供口服的泡腾片（A对）一般宜用100～150ml凉开水或温水浸泡，严禁直接服用或口含。舌下片（B错）含服于舌下，含服时间一般控制在5min。激素类气雾剂（C错）使用后宜用温水漱口。缓、控释制剂（D错）除另有规定外，一般应整片或整丸吞服。透皮贴剂（E错）需贴敷于干净的皮肤，经皮给药。